男性，40岁，11月份发病，发热3天，血压72/40mmHg，血象：WBC18×10⁹/L，血小板56×10⁹/L，尿蛋白（+++），该病人的诊断首先应考虑为
A. 革兰阴性菌引起的败血症
B. 急性肾小球肾炎
C. 流行性出血热
D. 血小板减少性紫癜
E. 革兰阳性菌引起的败血症

正确答案：C。流行性出血热